方中大黄先煎，取其“上者治宜缓”的方剂是
A. 大黄牡丹汤
B. 大承气汤
C. 大陷胸汤
D. 大黄附子汤
E. 温脾汤

正确答案：C。大陷胸汤

解析：方中大黄先煎，取其“上者治宜缓”的方剂是大陷胸汤，大黄、芒硝荡涤肠胃，泻结泄热，软坚散结。生大黄先煎，他药后入，也是取其久煎缓荡邪热，配芒硝、甘遂使水热之邪从肠腑而下，三药共奏“泻热逐水”之功。（C对）。大黄牡丹汤大黄、牡丹皮、桃仁、冬瓜仁一起水煎，后内芒硝（A错）。大承气汤先煎厚朴、枳实，后下大黄，芒硝（B错）。大黄附子汤中大黄、附子、细辛水煎服（D错）。温脾汤中大黄与其他六味药一起水煎服（E错）。